制备倒凹是为了
A. 获得良好的抗力形
B. 便于垫底
C. 便于充填
D. 获得良好的固位形
E. 便于放置盖髓剂

正确答案：D。获得良好的固位形

解析：本题考查制备倒凹的目的。倒凹是一种机械固位，一般成洞底略大于洞口的形态，从而防止充填体与洞底呈垂直方向的脱位，获得良好的固位形（D对）。制备倒凹可产生无基釉，不利于获得良好的抗力形（A错）。制备窝洞的目的是为了便于垫底（B错）、充填（C错）和放置盖髓剂（E错）。